20年来在某医院住院的1000例肺癌患者中，吸烟者占75%，不吸烟者仅为25%，说明吸烟者易患肺癌
A. 正确，因为这是患者中的吸烟率
B. 正确，因为吸烟者中肺癌的发生率为不吸烟者的3倍
C. 错误，因为资料来自一家医院，代表性不够
D. 错误，因为无对照组的吸烟比例
E. 错误，因为没有计算P值

正确答案：D。错误，因为无对照组的吸烟比例

解析：本题考查病例对照研究的相关内容。病例对照研究是以确诊的患有某特定疾病的病人作为病例，以不患有该病但具有可比性的个体作为对照，通过询问，实验室检查或复查病史，搜集既往各种可能的危险因素的暴露史，测量并比较病例组与对照组中各因素的暴露比例，经统计学检验，若两组差别有意义，则可认为因素与疾病之间存在着统计学上的关联。本题中因为无对照组的吸烟比例，所以不能说明吸烟者易患肺癌（D对ABCE错）。